严重的组织创伤引起弥散性血管内凝血的主要机制是
A. 凝血酶原转变为凝血酶
B. 红细胞释放磷脂和ADP
C. 激活因子Ⅻ，启动内源性凝血系统
D. 释放组织因子，启动外源性凝血系统
E. 损伤血管内皮细胞致胶原暴露

正确答案：D。释放组织因子，启动外源性凝血系统

解析：释放组织因子，启动外源性凝血系统（D对ABCE错）出现在严重的组织创伤时，损伤血管内皮细胞，损伤的血管内皮细胞释放大量组织因子，启动外源性凝血系统。凝血酶原转变为凝血酶（A错）是锯鳞蛭蛇毒等促凝物质进入血液的作用。红细胞释放磷脂和ADP（B错）是异型输血、症疾、阵发性睡眠性血红蛋白尿等，特别是伴有较强免疫反应的急性溶血时，可引起红细胞大量破坏的主要机制。 激活因子Ⅻ，启动内源性凝血系统（C错）是缺氧、酸中毒、抗原－抗体复合物、严重感染、 毒素等原因，均可损伤血管内皮细胞损伤血管内皮细胞致胶原暴露（E错）产生的作用。